关于老年人营养叙述正确的是
A. 因肝肾功能下降，应降低蛋白质的供能比
B. 宜多吃果糖和蜂蜜等富含果糖的食物
C. 由于消化吸收率降低，蛋白质的摄入量应高于中年人的RNI值
D. 为防止超重和肥胖，老年人应保持能量负平衡
E. 易出现维生素摄入不足

正确答案：E。易出现维生素摄入不足

解析：本题考查老年人营养的相关内容。老年人对维生素的利用率下降，易出现维生素摄入不足（E对），应保证老年人各种维生素的摄入量充足，以促进代谢、延缓机体功能衰退、增强抗病能力。老年人因肝肾功能下降，摄入蛋白质过多可增加肝脏和肾脏的负担。建议老年人膳食蛋白质的RNI男女分别为65g/d和55g/d，优质蛋白质应占总蛋白质摄入量的50%（AC错）。老年人的糖耐量降低，血糖的调节作用减弱，容易发生血糖增高。过多的糖在体内还可转变为脂肪，引起肥胖、高脂血症等疾病。因此，老年人应降低单糖、双糖和甜食的摄入量（B错），增加膳食中膳食纤维的摄入。老年人对能量的需要降低，所以膳食能量的摄入主要以体重来衡量。老年人的体重应维持在正常稳定水平，不应过度苛求减重，体重过高或过低都会影响健康（D错）。